“至虚有盛候”的病机是
A. 阴损及阳
B. 阳损及阴
C. 真虚假实
D. 虚实错杂
E. 真实假虚

正确答案：C。真虚假实

解析：真虚假实，是指病机的本质为“虚”，但表现为“实”的临床假象。一般由于正气虚弱，脏腑经络之气不足，推动、激发功能减退所致，故真虚假实证又称为“至虚有盛候”。（C对）。阴损及阳（A错）指由于阴气亏损，累及阳气生化不足，或阳气无所依附而耗散，从而在阴虚的基础上又出现了阳虚，进而形成了以阴虚为主的阴阳两虚的病理状态。阳损及阴（B错）指由于阳气虚损，无阳则阴无以生，从而在阳虚的基础上又导致了阴虚，形成以阳虚为主的阴阳两虚的病理变化。虚实错杂（D错）指在疾病过程中，邪盛和正虚同时存在的病理状态。邪盛正伤，或疾病失治、误治，以致病邪久留，损伤人体正气；或因虚体受邪，正气无力驱邪外出；或本已正虚，又兼内生水湿、痰饮、瘀血等病理产物凝结阻滞，都可形成正虚邪实的虚实错杂病变。真实假虚（E错）指病机的本质为“实”，但表现出“虚”的临床假象。一般是由于邪气亢盛，结聚体内，阻滞经络，气血不能外达所致，故真实假虚又称为“大实有羸状”。